DIC所致休克时，下列哪一项叙述妥当？
A. 广泛微血栓形成
B. 血管床容量扩大
C. 血容量减少
D. 心泵功能障碍
E. 以上都是

正确答案：E。以上都是

解析：急性DIC时常伴有休克。DIC 和休克可互为因果，形成恶性循环。广泛微血栓形成（A对），阻塞微血管，使回心血量明显减少。血管床容量扩大（B对），FDP 的某些成分可增强组胺、激肽的作用，促进微血管的扩张。血容量减少（C对）广泛出血所致。心泵功能障碍（D对，E为本题正确答案），心肌损伤所致，使心输出量减少。